关于难溶性药物速释型固体分散体的叙述，错误的是
A. 载体材料为水溶性
B. 载体材料对药物有抑晶性
C. 载体材料提高了药物分子的再聚集性
D. 载体材料提高了药物的可润湿性
E. 载体材料保证了药物的高度分散性

正确答案：C。载体材料提高了药物分子的再聚集性

解析：本题考查固体分散体。固体分散体的载体材料能够抑制已分散的药物再聚集（C错，为本题正确答案），保持药物的高度分散性（E对）。难溶性药物制备速释型固体分散体时，载体材料为水溶性（A对），能够抑制药物转化为晶体状态（B对），提高药物的可润湿性（D对），有利于药物的快速释放。